关于建立健全，覆盖城乡居民基本医疗卫生制度的基本内容的说法错误的是
A. 加快建立健全公共卫生服务体系
B. 加快建立覆盖城乡居民的多层次医疗保障体系
C. 完善以公立医院和非公立医院并重的医疗服务体系
D. 建立健全以国家基本药物制度为基础的药物，药品供应保障体系

正确答案：C。完善以公立医院和非公立医院并重的医疗服务体系

解析：本题考查基本医疗卫生制度的建立。政府举办非营利性医疗卫生机构，在基本医疗卫生事业中发挥主导作用，保障基本医疗卫生服务公平可及（C错，为本题正确答案）。《中华人民共和国基本医疗卫生与健康促进法》第三章医疗卫生机构第三十九条：医疗卫生服务体系坚持以非营利性医疗卫生机构为主体、营利性医疗卫生机构为补充。政府举办非营利性医疗卫生机构，在基本医疗卫生事业中发挥主导作用，保障基本医疗卫生服务公平可及。以政府资金、捐赠资产举办或者参与举办的医疗卫生机构不得设立为营利性医疗卫生机构。医疗卫生机构不得对外出租、承包医疗科室。非营利性医疗卫生机构不得向出资人、举办者分配或者变相分配收益。基本医疗卫生制度的建立：深化医药卫生体制改革是全面深化改革的重要内容，是维护人民群众健康福祉的重大民生工程、民心工程。2009年4月6日，《中共中央国务院关于深化医药卫生体制改革的意见》（中发〔2009〕6号）（以下简称“新医改意见”）发布，标志着我国医药卫生体制进入深化改革新阶段。新医改意见坚持把基本医疗卫生制度作为公共产品向全民提供的核心理念，坚持保基本、强基层、建机制的基本原则，首次明确了深化医药卫生体制改革总体目标是建立健全覆盖城乡居民的基本医疗卫生制度，为群众提供安全、有效、方便、价廉的医疗卫生服务。即建设覆盖城乡居民的公共卫生服务体系（B对）、医疗服务体系、医疗保障体系、药品供应保障体系，形成四位一体的基本医疗卫生制度。四大体系相辅相成，配套建设，协调发展。同时，完善保障医药卫生体系有效规范运转的体制机制，完善医药卫生的管理、运行、投入、价格、监管体制机制，建立协调统一的医药卫生管理体制、高效规范的医药卫生机构运行机制、政府主导的多元卫生投入机制、科学合理的医药价格形成机制、严格有效的医药卫生监管体制、可持续发展的医药卫生科技创新机制和人才保障机制、实用共享的医药卫生信息系统、医药卫生法律制度，保障医药卫生体系有效规范运转。